缩宫素的临床应用不包括
A. 催产
B. 引产
C. 流产
D. 促进排乳
E. 产后出血

正确答案：C。流产